DNA复性是指
A. 不同的核酸链经变性处理，它们之间形成局部的双链
B. 一小段核苷酸聚合体的单链，用放射性核素或生物素来标记其末端或全链
C. 运输氨基酸
D. 单股DNA恢复成双股DNA
E. 50%双链DNA变性时的温度

正确答案：D。单股DNA恢复成双股DNA